绞窄性腹股沟斜疝在行肠切除吻合术后应行
A. Ferguson疝修补术
B. Bassini疝修补术
C. McVay疝修补术
D. 疝囊高位结扎
E. Shouldice修补术

正确答案：D。疝囊高位结扎

解析：绞窄性腹股沟斜疝因肠管坏死而局部有严重感染，通常采用单纯疝囊高位结扎（D对），而不施行疝修补术，因感染常使修补失败。腹壁的缺损可在以后另作择期手术予以加强。Ferguson疝修补术（A错）、Bassini疝修补术（B错）、McVay疝修补术（C错）和Shouldice修补术（E错）均为疝的修补术，不是绞窄性疝肠切除吻合术后的处理方法。